治疗湿疮肿毒，便血痔血，应选用的药物是
A. 山茱萸
B. 五味子
C. 桑螵蛸
D. 五倍子
E. 海螵蛸

正确答案：D。五倍子

解析：五倍子外用能收湿敛疮，且有解毒消肿之功，治湿疮流水、溃疡不敛、疮疖肿毒、肛脱不收、子宫下垂等。本品还有收敛止血作用，可治疗便血、痔血（D对）。山茱萸治疗肝肾亏虚，眩晕耳鸣，腰膝酸痛，阳痿；遗精滑精，遗尿尿频；月经过多，崩漏带下；大汗虚脱；内热消渴（A错）。五味子治疗久咳虚喘；梦遗滑精，遗尿尿频；久泻不止；自汗，盗汗；津伤口渴，内热消渴；心悸失眠（B错）。桑螵蛸治疗肾虚不固，遗精滑精，遗尿尿频，小便白浊；肾虚阳痿（C错）。海螵蛸治疗吐血衄血，崩漏便血，外伤出血；遗精滑精，赤白带下；胃痛吞酸；湿疹湿疮，溃疡不敛（E错）。